用住院患者做研究对象易发生
A. 选择偏倚
B. 信息偏倚
C. 混杂偏倚
D. 选择偏倚和混杂偏倚
E. 信息偏倚和混杂偏倚

正确答案：A。选择偏倚